正确描述肾的是
A. 属腹膜外位器官
B. 左肾位置略高于右肾
C. 内侧缘中部凹陷称肾门
D. 肾门向内续于肾窦
E. 上述全部正确

正确答案：E。上述全部正确

解析：肾位于腹膜后间隙内，为腹膜外位器官（A对）。由于肝的挤压，所以右肾位置略低（B对）。肾门为肾内侧缘中部的凹陷（C对）。肾窦是肾门的延续（D对），容纳肾血管、肾小盏、肾大盏、肾盂和脂肪等结构。